附子的性能特点有
A. 辛热纯阳
B. 峻烈有毒
C. 上助心阳
D. 中温脾阳
E. 下壮肾阳

正确答案：A、B、C、D、E。辛热纯阳；峻烈有毒；上助心阳；中温脾阳；下壮肾阳

解析：本题考查的是附子的性能特点。附子的性能特点有辛热纯阳（A对）、峻烈有毒（B对）、上助心阳（C对）中温脾阳（D对）与下壮肾阳（E对）。附子：【性能特点】本品辛热纯阳，有毒力猛，入心、肾、脾经。上助心阳、中温脾阳、下壮肾阳，为补火助阳、回阳救逆之要药，治亡阳及阳虚诸证每用。辛热走散，为散阴寒、除风湿、止疼痛之猛药，治寒湿诸痛常投。